以下用具中没有清洁牙齿邻面菌斑作用的是
A. 牙间刷
B. 牙签
C. 牙间冲洗器
D. 牙线
E. 橡胶按摩器

正确答案：C。牙间冲洗器

解析：本题考查邻面清洁措施。以下用具中没有清洁牙齿邻面菌斑作用的是牙间冲洗器（C错，为本题的正确答案）。牙间冲洗器主要是帮助清除软垢和食物残渣，没有清洁牙齿邻面菌斑的作用。一般的刷牙方法只能清除颊舌面及咬合面的菌斑，而在牙齿的邻面常余留菌斑，为加强邻面清洁，除刷牙外，还须辅以其他工具和方法如牙间刷（A对）、牙签（B对）、牙线（D对）、锥形橡皮尖、冲洗器等，才能彻底清除菌斑。橡胶按摩器（E对）由锥体橡胶及金属或塑料柄构成，主要作用是按摩牙龈，增强血液循环和上皮组织的角化程度，同时可通过橡胶的机械作用去除邻面颈部的牙菌斑，以维护牙周组织的健康。